脊髓灰质炎第二次接种年龄应该是
A. 1个月
B. 2个月
C. 3个月
D. 4个月
E. 5个月

正确答案：C。3个月

解析：掌握“儿童保健原则”知识点。